符合二尖瓣关闭不全的典型表现是
A. 右心房增大
B. S₁增强
C. 心尖部全收缩期吹风样杂音
D. P₂降低
E. 右心室增大

正确答案：C。心尖部全收缩期吹风样杂音

解析：二尖瓣关闭不全的典型表现是心尖部全收缩期吹风样杂音（C对）。二尖瓣关闭不全时，心室舒张期过度充盈使二尖瓣漂浮第一心音减弱，即S₁减弱（B错），A₂﹤P₂（D错）。二尖瓣关闭不全多伴有左心房和左心室增大，一般无右心房增大（A错）和右心室增大（E错）。